某男，54岁。1年前，爪甲菲薄发软，影响工作。虽多方求治但收效不大。刻下面黄，夜寐多梦，时有头晕心慌，纳食与二便正常；舌淡红苔薄白脉细沉。血红蛋白偏低。医师诊为肝血不足、筋爪失养治养血补肝益筋。药用熟地黄12g、山茱萸10g、当归10g、炒白芍10g、五味子5g打碎、阿胶珠10g、炒酸枣仁15g打碎、川芎5g、木瓜10g、生牡蛎30g打碎先煎、夜交藤15g。10剂每日1剂水煎分2次服。以此方加减治疗数月爪甲复常。人参归脾丸的使用注意事项不包括
A. 孕妇慎用
B. 忌烟酒、浓茶
C. 痰湿壅盛者慎用
D. 阴虚脉数者慎用
E. 热邪内伏者慎用

正确答案：A。孕妇慎用

解析：本题考查的是人参归脾丸的使用注意事项。人参归脾丸的使用注意事项不包括孕妇慎用（A错，为本题正确答案）。人参归脾丸：【注意事项】热邪内伏、阴虚脉数以及痰湿壅盛者慎用（CDE对）。服药期间，应进食营养丰富而易消化吸收的食物，饮食有节；忌食生冷食物，忌烟酒、浓茶（B对）；保持精神舒畅，劳逸适度；忌过度思虑，避免恼怒、抑郁、惊恐等不良情绪。